对于儿童期常见的心理-行为问题，下列哪种在女童中的患病率高于男童
A. 注意缺陷多动障碍
B. 习惯性抽动
C. 儿童癔症
D. 儿童孤独症
E. 品行问题

正确答案：C。儿童癔症